下列引起原发性闭经的疾病是
A. 空蝶鞍综合征
B. Turner综合征
C. 神经性厌食
D. Asherman综合征
E. 咽颅管瘤

正确答案：B。Turner综合征

解析：原发性闭经较少见，多为遗传原因或先天性发育缺陷引起。根据第二性征的发育情况，分为以下两种：第二性征存在的原发性闭经，如米勒管发育不全综合征、雄激素不敏感综合征、对抗性卵巢综合征、生殖道闭锁和真两性畸形；第二性征缺乏的原发性闭经，如低促性腺激素性腺功能减退、高促性腺激素性腺功能减退（包括Turner综合征）（B对）、46，XX单纯性腺发育不良和46，XY单纯性腺发育不良）。继发性闭经发生率明显高于原发性闭经，包括下丘脑性闭经（最常见）、垂体性闭经、卵巢性闭经和子宫性闭经等。而空蝶鞍综合征（A错）可引起垂体性闭经。神经性厌食（C错）和咽颅管瘤（E错）可引起下丘脑性闭经。Asherman综合征（D错）可引起子宫性闭经。